若多种不同情况与某病的存在有联系，且这些情况均有一个共同的因素，则该因素可能是该病的病因
A. 求同法
B. 求异法
C. 共变法
D. 类推法
E. 假说

正确答案：A。求同法

解析：本题考查求同法。若多种不同情况与某病的存在有联系，且这些情况均有一个共同的因素，则该因素可能是该病的病因。该方法属于求同法（A对BCDE错）。